哪种喹诺酮类药比较适用于肺部感染
A. 诺氟沙星
B. 氧氟沙星
C. 依诺沙星
D. 培氟沙星
E. 吡哌酸

正确答案：B。氧氟沙星

解析：临床上氟喹诺酮类呼吸系统感染：左氧氟沙星、莫西沙星与万古霉素合用，首选用于治疗青霉素高度耐药的肺炎链球菌感染。氟喹诺酮类可用于支原体肺炎、衣原体肺炎、嗜肺军团菌引起的军团病。掌握“喹诺酮类”知识点。